既泻水逐饮，又祛痰止咳的药是
A. 巴豆
B. 甘遂
C. 芫花
D. 红大戟
E. 牵牛子

正确答案：C。芫花

解析：本题考查的是芫花的功效。既泻水逐饮，又祛痰止咳的药是芫花（C对）。芫花：【功效】泻水逐饮，祛痰止咳。外用杀虫疗疮。巴豆（A错）：【功效】泻下冷积，逐水退肿，祛痰利咽，蚀疮去腐。甘遂（B错）：【功效】泻水逐饮，消肿散结。红大戟（D错）：【功效】泻水逐饮，消肿散结。牵牛子（E错）：【功效】泻下，逐水，去积，杀虫。